糖尿病患者，血糖低于多少且无酸中毒症状时可考虑拔牙
A. 150mg/dl
B. 160mg/dl
C. 170mg/dl
D. 180mg/dl
E. 190mg/dl

正确答案：B。160mg/dl

解析：本题考查系统疾病对牙拔除术的影响及拔牙禁忌证-糖尿病。糖尿病患者，血糖低于160mg/dl（B对）且无酸中毒症状时可考虑拔牙。糖尿病患者拔牙时，空腹血糖低于160mg/dl（8.88mmol/L）且无酸中毒症状时可考虑拔牙。糖尿病患者若血糖值过高（CDE错），术后发生感染的几率高于正常人，伤口愈合迟缓，所以拔牙之前应控制血糖。当然低于150mg/dl（A错）也是可以拔牙的，甚至更好，但是血糖低于160mg/dl已经在安全范围内，对于需要拔除的牙齿可以考虑拔除了。